阿司匹林没有哪种作用
A. 抑制环加氧酶
B. 抗炎抗风湿
C. 抑制PG合成，易造成胃黏膜损伤
D. 高剂量时才能抑制血小板聚集
E. 高剂量时也能抑制PGI₂的合成

正确答案：D。高剂量时才能抑制血小板聚集